患者因身劳汗出，常衣里冷湿，日久腰部酸楚冷痛，身体沉重，腰重如带五千钱；但口不渴，小便自利，饮食如故，治宜
A. 甘草干姜汤
B. 茯苓桂枝五味甘草汤
C. 苓桂术甘汤
D. 甘姜苓术汤
E. 茯苓桂枝甘草大枣汤

正确答案：D。甘姜苓术汤

解析：肾着由寒湿痹着腰部所致，因腰为肾之外府，故名肾着。其成因为劳动汗出，湿衣贴身，致使寒湿侵袭，阳气痹阻。症见腰中冷，如坐水中，形如水状，腰以下冷痛。腰重如带五千钱。因病属下焦。但未及内脏。故口不渴。小便自利饮食如故。治疗时只需将经络肌肉的寒湿祛除，则肾着可愈。甘姜苓术汤中干姜配甘草温中散寒，茯苓配白术健脾祛湿。四药合用，共奏温中健脾、散寒除湿之功（D对）。因主治肾着，故又名肾着汤。